与G蛋白偶联的受体是
A. 环状受体
B. 跨膜受体
C. 催化性受体
D. 细胞核内受体
E. 胞质内受体

正确答案：B。跨膜受体